《中国药典》规定，以杜鹃素为指标成分的药材是
A. 满山红
B. 葛根
C. 银杏叶
D. 槐花
E. 黄芩

正确答案：A。满山红

解析：本题考查的是满山红的化学成分。《中国药典》规定，以杜鹃素为指标成分的药材是满山红（A对）。《中国药典》以杜鹃素为对照品对满山红进行含量测定。要求杜鹃素含量不少于0.08%。《中国药典》以葛根素为指标成分对葛根（B错）进行含量测定，要求含葛根素不得小于2.4%。《中国药典》以总黄酮醇苷和萜类内酯为指标成分对银杏叶（C错）进行含量测定。要求总黄酮醇苷不少于0.4%，对照品采用槲皮素、山柰素和异鼠李素；要求萜类内酯不少于0.25%，对照品采用银杏内酯A、银杏内酯B、银杏内酯C和白果内酯。《中国药典》以总黄酮和芦丁为指标成分对槐米或槐花（D错）进行含量测定。要求槐花总黄酮不少于8.0%，槐米总黄酮不少于20.0%，对照品采用芦丁；要求芦丁含量，槐花不得少于6.0%，槐米不得少于15.0%。《中国药典》以黄芩苷为指标成分对黄芩（E错）进行含量测定，要求药材含量不得少于9.0%，饮片含量不得少于8.0%。